细胞内液中主要的阳离子是
A. Na⁺
B. Ca²⁺
C. K⁺
D. NH₄⁺
E. Fe²⁺

正确答案：C。K⁺

解析：钠泵每分解一分子ATP可逆浓度差将3个Na⁺移出胞外，将2个K⁺移入胞内，其直接效应是维持细胞膜两侧Na⁺和K⁺的浓度差，使细胞外液中的Na⁺浓度达到胞质内的10倍左右，细胞内的K⁺浓度达到细胞外液的30倍左右。细胞内液中主要的阳离子是K⁺（C对），细胞外液中主要的阳离子是Na⁺（A错）。